根据GSP的规定，怕压药品应
A. 定期循环抽查
B. 定期送样检查
C. 采取隔离措施
D. 集中存放
E. 定期翻垛

正确答案：E。定期翻垛